肺痈病位主要在
A. 肝
B. 心
C. 脾
D. 肺
E. 肾

正确答案：D。肺

解析：肺痈主要是风热火毒，壅滞于肺，热盛血瘀，蕴酿成痈，血败肉腐化脓，肺络损伤而致，故病位在肺（D对），与心肝脾肾关系不大（ABCD错）。